血糖控制不良的糖尿病患者并发牙周炎时牙周临床表现包括
A. 易发生牙周脓肿
B. 龈缘红肿呈肉芽状增生
C. 牙槽骨破坏迅速
D. 深牙周袋和牙松动
E. 以上均是

正确答案：E。以上均是

解析：糖尿病主要是影响牙周炎的发病和进程，尤其是血糖控制不良的患者，其牙周组织的炎症较重，龈缘红肿呈肉芽状增生，易出血和易发生牙周脓肿，牙槽骨破坏迅速，导致深牙周袋和牙松动。掌握“牙周疾病与全身疾病和健康的关系”知识点。